如患者误服强碱性溶液后，不能用来口服治疗的是
A. 牛奶
B. 蛋清
C. 冷生理盐水
D. 弱酸性液体
E. 弱碱性液体

正确答案：E。弱碱性液体

解析：患者误服强碱性溶液后，不能口服弱碱性液体（E错，为本题正确答案），弱碱性液体会加重碱性溶液的腐蚀。牛奶（A对）、蛋清（B对）可保护胃肠粘膜。冷生理盐水（C对）可稀释强碱性溶液。弱酸性液体（D对）能中和强碱性溶液而减少其对机体的损害。A、B、C、D项均可用于误服强碱性溶液的洗胃治疗。